狂犬病病毒的内基氏小体最易在哪种组织中检出
A. 血液
B. 骨髓
C. 外周神经
D. 大脑海马回
E. 淋巴结

正确答案：D。大脑海马回

解析：人被动物咬伤或抓伤后，病毒可通过伤口进入体内，先在肌肉组织内复制增殖并感染肌神经，不经血行，而是沿神经轴索上行扩散至脊髓、大脑等致细胞损伤，在大脑海马回的椎体细胞质内可见圆形或椭圆形的嗜酸性包涵体即内基氏（Negri）小体，此为诊断动物狂犬病的指征。掌握“狂犬病、人乳头瘤病毒”知识点。